被认为是牙周炎“进展前沿”的菌斑
A. 龈上菌斑
B. 附着性龈下菌斑
C. 非附着性龈下菌斑
D. 陈旧的龈上菌斑
E. 窝沟处龈上菌斑

正确答案：C。非附着性龈下菌斑

解析：本题考查慢性牙周炎的病因，表现诊断及预后。非附着性龈下菌斑。龈缘以下位于附着性龈下菌斑的表面或直接与龈沟上皮、袋内上皮接触的龈下菌斑，为结构较松散的菌群，主要为革兰阴性厌氧菌，如牙龈卟啉单胞菌、福赛坦菌和具核梭杆菌等，还包括许多能动菌和螺旋体。在牙周炎快速进展时，非附着龈下菌斑（C对）明显增多，毒力增强，与牙槽骨的快速破坏有关，与牙周炎的发生发展关系密切，被认为是牙周炎的“进展前沿”。